慢性萎缩性胃炎的病理改变中属癌前病变的是
A. 明显肠上皮化生
B. 中度以上不典型增生
C. 胃小凹上皮增生
D. 假幽门腺化生
E. 假幽门腺化生伴肠上皮化生

正确答案：B。中度以上不典型增生

解析：慢性萎缩性胃炎的病理改变包括炎症、化生、萎缩、不典型增生（异型增生）。化生包括肠上皮化生（A错）、假幽门腺化生（D错）及假幽门腺化生伴肠上皮化生（E错），与癌变并无直接联系，只是当化生分布范围较广时，会增加癌变的风险，并非癌前病变。不典型增生是细胞在再生过程中过度增生和分化缺失，根据异型程度分为轻、中、重度，为胃癌的癌前病变（B对）。胃小凹上皮增生（C错）常见于浅表性胃炎，不属于癌前病变。